额窦开口于
A. 最上鼻道
B. 上鼻道
C. 中鼻道
D. 下鼻道
E. 蝶筛隐窝

正确答案：C。中鼻道

解析：额窦开口于中鼻道（C对）。